抛射剂是气雾剂喷射药物的动力，常用作抛射剂的是
A. 液状石蜡
B. 交联聚维酮（PVPP）
C. 四氟乙烷（HFA134a）
D. 乙基纤维素（EC）
E. 聚山梨酯80

正确答案：C。四氟乙烷（HFA134a）

解析：本题考查抛射剂。常用作气雾剂抛射剂的是四氟乙烷（HFA134a）（C对）；液状石蜡（A错）可用作冷凝剂；交联聚维酮（PVPP）（B错）常用作片剂崩解剂；乙基纤维素（EC）（D错）为片剂常用的黏合剂；聚山梨酯80（E错）又叫吐温80，常用作栓剂吸收促进剂。